口服等量碳酸氢钠，增加其乙酰化代谢物溶解度的药物是
A. 磺胺嘧啶
B. 链霉素
C. 红霉素
D. 苯巴比妥
E. 水杨酸钠

正确答案：A。磺胺嘧啶

解析：本题考查药物的联合应用。口服等量碳酸氢钠，增加其乙酰化代谢物溶解度的药物是磺胺嘧啶（A对）。磺胺药物在肝中被乙酰化，其乙酰化物溶解度不高，尤其在偏酸性的尿液中，口服等量碳酸氢钠，可增加磺胺药及其乙酰化物的溶解度，加速排泄。